头面部触压觉的传导通路中的第二级神经元是
A. 三叉神经中脑核
B. 室旁核
C. 三叉神经脑桥核
D. 三叉神经节细胞
E. 无

正确答案：C。三叉神经脑桥核

解析：头面部的痛温觉和触压觉传导通路第2级神经元的胞体在三叉神经脊束核和三叉神经脑桥核内（C对）。三叉神经中脑核（A错）为三叉神经运动核，发出神经支配咀嚼肌。室旁核（B错）是下丘脑的重要内分泌核团。